流行性出血热少尿期的治疗不包括
A. 补充血容量
B. 利尿
C. 导泻疗法
D. 放血疗法
E. 维持酸碱平衡

正确答案：A。补充血容量

解析：流行性出血热低血压休克期的治疗包括：补充血容量（A错，为本题正确答案）、纠正酸中毒、静脉滴注血管活性药、静脉滴注强心剂与糖皮质激素的应用、中医辨证论治。流行性出血热少尿期治疗包括：稳定内环境、促进利尿（B对）、导泻疗法（C对）、透析疗法，透析有助于纠正酸碱失衡（E对）、中医辨证论治；放血疗法（D对）能降低血容量，有助于预防高血容量综合征。